青春期功能性子宫出血的原因多为
A. 子宫肌瘤
B. 下丘脑-垂体-卵巢轴功能紊乱
C. 卵巢肿瘤
D. 生殖器官感染
E. 垂体肿瘤

正确答案：B。下丘脑-垂体-卵巢轴功能紊乱

解析：本题考查青春期功能性子宫出血的原因。青春期因下丘脑-垂体-卵巢轴功能紊乱（B对ACDE错）会发生各种与生殖内分泌有关的疾病，如功能失调性子宫出血等。因卵巢不能定期产生成熟卵泡，排卵发生障碍，体内的雌二醇激素水平下降。雌激素对脑垂体分泌的促卵泡素、黄体生成素负反馈的作用减弱，使血液中的促卵泡素和黄体生成素反馈性增高，孕酮缺乏，子宫内膜增生不均或增生期内膜不能转化成分泌期，造成子宫内膜的不规则脱落。